健康危险度评价的危害鉴定中，有害效应包括以下四种类型，除外
A. 致癌（包括体细胞致突变）性
B. 致生殖细胞突变
C. 器官、细胞病理学损伤
D. 非特异损伤
E. 发育毒性（致畸性）

正确答案：D。非特异损伤

解析：本题考查危害鉴定的相关内容。危害鉴定是健康危险度评价的首要步骤，属于定性评价阶段，目的是确定在一定的接触条件下，被评价的化学物是否会产生健康危害及其有害效应的特征。危害鉴定中有害效应类型包括器官、细胞病理学损伤（C对）和致癌（A对）致畸（E对）致突变（B对）。非特异损伤（D错，为本题正确答案）不是危害鉴定中有害效应的类型。